患者，男，43岁。尿道中有白色分泌物滴出3年，劳累后更为明显，伴腰膝酸冷，放射至会阴部，形寒肢冷，精神不振，头晕。治疗应首选
A. 龙胆泻肝丸
B. 知柏地黄丸
C. 左归丸
D. 济生肾气丸
E. 独活寄生汤

正确答案：D。济生肾气丸

解析：患者为中年男性，尿道中有白色分泌物滴出的症状符合中医白浊的表现；由腰膝酸冷，形寒肢冷可判断为肾阳虚损证，治当补肾助阳。龙胆泻肝丸用于治疗慢性前列腺炎湿热蕴结证，功能清利湿热（A错）。知柏地黄丸用于治疗慢性前列腺炎阴虚火旺证，功能滋阴降火（B错）。左归丸功能滋阴补肾，填精益髓，主治真阴不足证（C错）。济生肾气丸用于治疗慢性前列腺炎肾阳虚损证，功能补肾助阳（D对）。独活寄生汤功能祛风湿，止痹痛，益肝肾，补气血，主治痹证日久，肝肾两虚，气血不足证（E错）。